男，25岁，爱上了比他大30多岁的婶婶，明知不能继续这种关系，但不能摆脱，而来寻求治疗，对于该患者首选的治疗方法为
A. 生物反馈
B. 精神分析
C. 放松训练
D. 眼动治疗
E. 系统脱敏

正确答案：B。精神分析

解析：精神分析理论认为对人的正常心理和异常心理影响较大的主要在潜意识层面。精神分析疗法是指在精神分析理论的指导下，治疗者运用自由联想、释梦、移情与反移情分析、阐释等技术，发现病人压抑在潜意识中的冲突，使病人领悟到心理问题的潜意识症结，让焦虑的情绪得到宣泄，从而使其能以现实的方式处理和适应各种情况。经典精神分析疗法，主要用于治疗各种神经症、心境障碍、某些人格障碍等。题目中患者爱上自己的婶婶，可以通过精神分析疗法，使患者领悟到自己心理问题的潜意识症结，从而摆脱心理问题（B对）。生物反馈疗法（A错）对多种与社会心理应激有关的心身疾病都有较好疗效，如紧张性头痛、血管性头痛等。放松训练（C错）对于缓解紧张性头痛、失眠、高血压、焦虑、愤怒等生理心理症状较为有效。眼动治疗（D错）主要用于治疗创伤后应激障碍。系统脱敏（E错）主要用于治疗恐怖症，也可用于癔症。